半夏泻心汤的组成药物除半夏、人参、炙甘草、干姜、大枣外，还有
A. 黄连  黄柏
B. 栀子  连翘
C. 黄连  黄芩
D. 柴胡   枳壳
E. 黄芩  黄柏

正确答案：C。黄连  黄芩

解析：本题考查方剂的组成，半夏泻心汤组成半夏、黄芩、干姜、人参、黄连、大枣、甘草，除半夏、人参、炙甘草、干姜、大枣外，还有黄连、黄芩（C对）。